血红素合成障碍所致的贫血是
A. 缺铁性贫血
B. 再生障碍性贫血
C. 海洋性贫血
D. 巨幼细胞贫血
E. 慢性病贫血

正确答案：A。缺铁性贫血

解析：铁是血红素合成的原料，缺铁和铁利用障碍都会影响血红素的合成。缺铁性贫血（A对）时，血红素合成原料铁缺乏，大量原卟啉不能与铁结合成为血红素，导致血红素合成障碍，继而造成血红蛋白生成减少，引起贫血。再生障碍性贫血（P547）（B错）是因多种机制和病因引起的骨髓造血功能衰竭所致的贫血；海洋性贫血（P555）（C错）是因珠蛋白合成障碍所致的贫血；巨幼细胞贫血（P544）（D错）是因维生素B₁₂或叶酸缺乏导致DNA合成障碍所致的贫血；慢性病贫血（E错）是因慢性炎症、感染或肿瘤引起的骨髓造血功能受抑、红细胞寿命缩短、铁利用障碍等多种机制所致的贫血，铁利用障碍是其机制之一，故最佳选项为A。